关于雷尼替丁，哪一项是错误的
A. 是H₂受体阻断药
B. 抑制胃酸分泌作用比西米替丁强
C. 也能中和胃酸，减轻对溃疡面的刺激
D. 肝功不良者t1/2明显延长
E. 对基础胃酸和夜间胃酸分泌都抑制

正确答案：C。也能中和胃酸，减轻对溃疡面的刺激

解析：H2受体阻断药，竞争性的阻断壁细胞基底膜的H2受体。对基础胃酸分泌的抑制作用最强，对进食等诱导的胃酸分泌抑制作用也有效。因此本类药物对以基础胃酸分泌为主的夜间胃酸分泌有良好的抑制作用，成为治疗十二指肠溃疡的首选。掌握“H1、H2受体阻断剂”知识点。